属于肾上腺受体激动剂的降低眼压药是
A. 地匹福林
B. 毛果芸香碱
C. 噻吗洛尔
D. 拉坦前列素
E. 托吡卡胺

正确答案：A。地匹福林

解析：本题考查降低眼压药的分类。地匹福林（A对）属于肾上腺素受体激动剂的降低眼压药。降低眼压药按作用特点可分为：1.拟M胆碱药：代表药为毛果芸香碱（B错）；2.β受体阻断剂：眼部滴用β受体阻断剂可通过阻断β受体，减少房水的生成，促进房水引流与排出，具有强大、持续的降低眼压作用，有效的控制眼压。代表药为卡替洛尔、美替洛尔、噻吗洛尔（C错）和倍他洛尔；3.前列腺素类似物：前列腺素类似物通过松弛睫状肌，增宽肌间隙，增加房水的葡萄膜巩膜通路外流而降低眼压。代表药为拉坦前列素（D错）、曲伏前列素、比马前列素；4.肾上腺素受体激动剂：肾上腺素受体激动剂通过减少房水生成和增加房水经小梁网的外流来发挥药效。代表药为地匹福林、溴莫尼定。托吡卡胺（E错）为散瞳药，用于散瞳和调节麻痹。